患者自汗，多尿，滑精，是因气的何种作用失常所致
A. 推动
B. 温煦
C. 防御
D. 固摄
E. 气化

正确答案：D。固摄

解析：固摄即固护、统摄和控制。气的固摄作用即防止液态物质无故流失。表现为：②固摄汗液、尿液、唾液、胃液、肠液，控制其分泌量、排泄量和有规律地排泄，防止其过多排出及无故流失；③固摄精液，防止其妄加排泄。患者自汗，多尿，滑精，是气的固摄作用失常导致的汗液、尿液、基尼、精液排泄失常（D对，ABCE错）。